拟调查某地人群高血压的现患率，可采用何种研究方法
A. 病例对照研究
B. 队列研究
C. 实验研究
D. 现况研究
E. 理论研究

正确答案：D。现况研究

解析：本题考查现况研究的概念。现况研究（D对ABCE错）是通过对特定时点（或期间）和特定范围内人群中的疾病或健康状况和有关因素的分布状况的资料收集、描述，从而为进一步的研究提供病因线索。该研究所得到的频率指标一般为特定时间内调查群体的患病率，故也称之为患病率研究。